决定大气污染程度最基本的因素是
A. 污染物的排放量
B. 排出高度
C. 有效排出高度
D. 与污染源的距离
E. 风速

正确答案：A。污染物的排放量

解析：本题考查决定大气污染程度最基本的因素。污染物的排放量（A对BCDE错）是决定大气污染程度的最基本的因素。燃料燃烧产生的污染物排放量与燃料的种类、消耗量、燃烧方式、燃烧是否充分有关；工业企业污染物的排放量受工业企业的数量生产性质生产规模、工艺过程、净化设备及其效率的影响。